可作旋转运动
A. 肩关节
B. 肘关节
C. 踝关节
D. 膝关节
E. 拇指腕掌关节

正确答案：A。肩关节

解析：肩关节为全身最灵活的关节，可作三轴运动，即冠状轴上的屈和伸，矢状轴上的收和展，垂直轴上旋内、旋外及环转运动”（A对）。肘关节的运动以肱尺关节为主，允许作屈、伸运动（B错）。踝关节能作背屈（伸）和距屈（屈）运动 （C错）。拇指腕掌关节囊厚而松弛，可作屈 、 伸、收、展、环转和对掌运动 （E错）。